HPV的宿主范围是
A. 人和哺乳动物
B. 人和灵长类动物
C. 人和猩猩
D. 所有温血动物
E. 人

正确答案：E。人

解析：人是HPV唯一的自然宿主，是人类肿瘤病毒。掌握“狂犬病、人乳头瘤病毒”知识点。